最易合并脓胸的肺炎是
A. 合并病毒肺炎
B. 金葡菌肺炎
C. 支原体肺炎
D. 腺病毒肺炎
E. 间质性肺炎

正确答案：B。金葡菌肺炎

解析：金葡菌肺炎（B对）是由金黄色葡萄球菌引起的急性肺化脓性炎症，易引起脓胸，且细菌性肺炎，如金黄色葡萄球菌、铜绿假单胞菌和肺炎克罗伯杆菌肺炎等可导致继发性肺脓肿，合并发生脓胸。而对于间质性肺炎（包括病毒性肺炎和支原体肺炎）病变主要发生在肺间质，不涉及肺实质的改变，极少发生脓胸（ACDE错）。